不属于HIV传播途径的是
A. 母婴传播
B. 性接触
C. 器官移植
D. 呼吸道传播
E. 输血

正确答案：D。呼吸道传播

解析：艾滋病的常见传播途径有性接触（B对）、血液接触（E对）和母婴传播（A对）。接受HIV 感染者的器官移植（C对）、人工授精或污染的器械等也可导致艾滋病的传播。呼吸道传播（D错，为本题正确答案）不传播艾滋病，主要传播呼吸系统疾病。